妊娠头3个月，可以使用的是
A. 泻药与雌激素
B. 喹诺酮类抗菌药
C. 四环素类抗生素
D. 氨基糖苷类抗生素
E. 胃动力药

正确答案：E。胃动力药

解析：本题考查特殊人群用药。妊娠头3个月，可以使用的是胃动力药（E对）。促胃肠动力药能增加胃肠推进蠕动，妊娠头3个月可以使用胃动力药助消化。大多数泻药都有引起子宫收缩的可能，易导致流产或早产。雌激素可能引起胎儿性发育异常（A错）。喹诺酮类抗菌药（B错）妊娠前期服用可致胎儿畸形。四环素类抗生素（C错）可透过胎盘屏障进入胎儿体内，沉积在牙齿和骨的钙质区中，可能会出现畸胎。氨基糖苷类抗生素（D错）可致胎儿永久性耳聋及肾脏损害。